大建中汤的组成药物是
A. 生附子、干姜、肉桂、炙甘草
B. 蜀椒、人参、干姜、饴糖
C. 蜀椒、人参、干姜、炙甘草
D. 蜀椒、生附子、肉桂、饴糖
E. 干姜、人参、桂枝、饴糖

正确答案：B。蜀椒、人参、干姜、饴糖

解析：大建中汤组成为蜀椒、干姜、人参、饴糖（大建中汤建中阳，蜀椒干姜参饴糖，阴盛阳虚腹冷痛，温补中焦止痛强）（B对）。